患者，女，50岁，已婚。近3天带下量多，色黄，质稀，有味，妇科检查；带下量多黄绿色，质稀，有泡沫。应首先考虑的是
A. 细菌性阴道病
B. 滴虫性阴道炎
C. 念珠菌阴道炎
D. 老年性阴道炎
E. 非淋菌性阴道炎

正确答案：B。滴虫性阴道炎

解析：细菌性阴道病多见淡黄色或血样脓性赤带，但无泡沫（A错）。滴虫性阴道炎多见黄色泡沫状白带，外阴瘙痒（B对）。念珠菌阴道炎多见凝乳状或豆腐渣样白带（C错）。老年性阴道炎多见稀薄淡黄或赤白带下，但无泡沫（D错）。非淋菌性阴道炎可见少量分泌物，有时有腥味，病人自认为白带增多，若为白色念珠菌引起，白带呈水样或脓性（E错）。